男，70岁，晨起时出现说话不流利，只能说一两个简单的字，但是能理解别人言语，也能理解书写的东西，读出来有困难。既往有高血压，高血脂病史，查体：言语不利，四肢肌力正常，病变部位应在优势半球
A. 颞上回后部
B. 缘上回
C. 颞中回后部
D. 额下回后部
E. 顶叶角回

正确答案：D。额下回后部

解析：患者口语表达障碍，理解能力可，表现为运动性失语，病变部位应在优势半球额下回后部（D对）。颞上回后部部（Wernicke区）（A错） 病变引起Wernicke失语，又称听觉性失语或感觉性失语，临床特点为严重听理解障碍，表现为患者听觉正常，但不能听懂别人和自己的讲话。缘上回（B错）病变引起传导性失语，临床表现为流利性口语患者语言中有大量错词，但自身可以感知到其错误，欲纠正而显得口吃，听起来似非流利性失语，但表达短语或句子完整。顶叶角回（E错）病变引起触觉失认即实体觉缺失，患者无初级触觉和位置觉障碍，闭眼后不能通过触摸辨别以前熟悉的物品。额中回后部病变：刺激性病变引起双眼向病灶对侧凝视，破坏性病变双眼向病灶侧凝视；更后部位的病变导致书写不能。